玻璃离子充填时，洞形要求哪一项是错误的
A. 洞有一定深度
B. 洞缘去除无基釉
C. 洞缘做洞斜面
D. 在不承受（牙合）力时，可不做出固位形
E. 洞底可呈圆弧形

正确答案：C。洞缘做洞斜面

解析：本题考查玻璃离子充填时洞形的要求。洞缘做洞斜面是树脂充填时的洞形要求，玻璃离子物理机械性能欠佳，充填时若制备洞缘斜面，则材料薄，易断裂（C错，为本题的正确答案）。备洞时要求洞有一定深度，可增加充填体的抗力（A对）。备洞时洞缘去除无基釉可防止充填后，无基釉受力断裂（B对）。玻璃离子与牙体组织有良好的粘结性，固位形的条件可以放宽，在不承受（牙合）力时，可不做出固位形（D对）。若龋洞很深，强调底平壁直有穿髓的风险，可将洞底制备成圆弧形（E对）。